小儿最常见的结核病是
A. 原发性肺结核
B. 粟粒性肺结核
C. 结核性脑膜炎
D. 结核性胸膜炎
E. 结核性腹膜炎

正确答案：A。原发性肺结核

解析：原发性肺结核（A对）是小儿最常见的结核病。粟粒性肺结核（B错）多在原发感染后3～6个月以内发生，发病率3岁以下占59.1%，而1岁以内者占30.6%，均不及原发性肺结核常见。结核性脑膜炎（C错）多见于3岁以内婴幼儿，约占60%，且随着卡介苗的接种和抗结核药物的应用以来，发病率有所降低。结核性胸膜炎（D错）、结核性腹膜炎（E错）一般较少见。